DTH所致的疾病是
A. 肿瘤
B. 乙型肝炎
C. 急性肾小球肾炎
D. 接触性皮炎
E. 过敏性鼻炎

正确答案：D。接触性皮炎